成年病人因失血致意识模糊、血压测不到，估计失血量
A. ＞800ml
B. ＞1000ml
C. ＞1200ml
D. ＞1400ml
E. ＞1600ml

正确答案：E。＞1600ml

解析：识记内容。重度休克意识模糊，收缩压在70mmHg以下甚至测不到，失血量在1600ml以上（E对）。